CD4⁺T细胞的主要功能是
A. 特异性杀伤作用
B. 吞噬作用
C. 辅助作用
D. 抑制作用
E. 抗原提呈作用

正确答案：C。辅助作用